在钙拮抗药的分类中，硝苯地平属于
A. 二氢吡啶类
B. 苯并噻氮（艹卓）类
C. 苯烷胺类
D. 二氢非吡啶类
E. 以上均不是

正确答案：A。二氢吡啶类